低阻力型休克最常见于下列哪一类休克？
A. 失血性休克
B. 心源性休克
C. 创伤性休克
D. 烧伤性休克
E. 感染性休克

正确答案：E。感染性休克

解析：高动力型休克又称为高排低阻型休克或暖休克，最常见于感染性休克（E对ABCD错），病原体或其毒素侵入机体后，引起高代谢和高动力循环状态，即出现发热、心排出益增加、外周阻力降低、脉压增大等临床特点。